有一种污染物，它是含氯碳氢化合物的燃烧产物，易溶于脂肪组织，是已知的人类致癌物，也是一种环境激素。该污染物可能是
A. 多环芳烃
B. 二噁英
C. 苯并（a）芘
D. 有机磷
E. 醛类化合物

正确答案：B。二噁英

解析：本题考查二噁英。二噁英（B对ACDE错）是一种含氯碳氢化合物的燃烧产物，它易溶于脂肪组织，是已知的人类致癌物，也是一种环境激素。